“娇脏”指的脏是
A. 肝
B. 心
C. 脾
D. 肺
E. 肾

正确答案：D。肺

解析：肺体清虚，性喜濡润，不耐寒热，不容异物；肺外合皮毛，开窍于鼻，与天气相通，外感六淫之邪从口鼻而入，易受邪侵，因此肺为娇脏（D对）。肝（A错）的生理特性：肝为刚脏；肝气升法。心（B错）的生理特性：主通明；心气下降。脾（C错）的生理特性：脾气上升；喜燥恶湿。肾（E错）的生理特性：肾主蛰守位；肾气上升。